新生儿肝脏缺乏葡萄糖醛酸转移酶，服用氯霉素可出现
A. 灰婴综合征
B. 干咳
C. 溶血性贫血
D. 变态反应
E. 停药反应

正确答案：A。灰婴综合征

解析：本题考查药物化学结构与第Ⅱ相生物转化的规律。氯霉素是通过葡萄糖醛酸转移酶结合代谢的，新生儿肝脏缺乏葡萄糖醛酸转移酶，难以排泄氯霉素，因此易引起药物在体内蓄积中毒，此病即为“灰婴综合征”（A对）。干咳（B错）主要由支气管及气管受刺激引起，如急性气管与支气管炎、支气管结核、支气管溃疡、支气管旁肿物压迫；胸膜炎症及各种刺激；纵隔疾病刺激支气管；咽与喉部炎症等。溶血性贫血（C错）是红细胞由于各种原因遭到破坏，且破坏的速率超过了骨髓造血的代偿能力，从而发生的贫血。急性溶血性贫血起病急骤，严重者可出现周围循环衰竭和急性肾衰竭，甚至危及生命；慢性溶血性贫血则会出现黄疸、脾大等表现。变态反应（D错）也叫超敏反应，是指免疫系统对一些对机体无危害性的物质如花粉、动物皮毛等过于敏感，发生免疫应答，对机体造成伤害。停药反应（E错）指长期服用药物,停药以后可能就会出现一些停药反应,包括恶心、呕吐,以及相应症状的一些反跳。